队列研究的基本特征是
A. 调查者必须在研究人群发病或发生死亡前开始研究，并同时确定暴露情况
B. 调查者必须根据疾病或死亡发生前就已经存在的暴露因素对研究人群分组，并追踪该人群中的新发病例或死亡者
C. 调查者必须在研究开始就分清人群队列
D. 调查者必须选择病例和合适的对照，并确定暴露组发病的危险是否大于非暴露组
E. 以上均不是

正确答案：B。调查者必须根据疾病或死亡发生前就已经存在的暴露因素对研究人群分组，并追踪该人群中的新发病例或死亡者